双肺有大中小水泡音的是
A. 肺炎球菌性肺炎
B. 急性肺水肿
C. 支气管扩张症
D. 肺结核
E. 肺淤血

正确答案：B。急性肺水肿

解析：双肺有大中小水泡音的是急性肺水肿（B对）。肺炎球菌性肺炎又叫大叶性肺炎，充血期可听及捻发音，实变期可听及病理性支气管呼吸音，消散期逐渐被湿性啰音（A错）。粗湿啰音:又称大水泡音。产生于气管、大支气管或空洞内，多出现在吸气早期。见于肺结核空洞、肺水肿、昏迷或濒死的患者，也可见于支气管扩张症（C错）。两肺底湿啰音，多见于肺淤血（E错）、肺水肿及支气管肺炎。一侧肺尖部局限性响性水泡音的是肺结核（D错）。